痣样基底细胞癌综合征的临床表现不包括
A. 多发性角化囊性瘤
B. 皮肤基底细胞痣（癌）
C. 分叉肋，颅骨异常
D. 大脑镰钙化
E. 眶距缩窄

正确答案：E。眶距缩窄

解析：本题考查牙源性颌骨囊肿。痣样基底细胞癌综合征的临床表现不包括眶距缩窄（E错，为本题正确答案）。多发性角化囊肿同时伴发皮肤基底细胞痣（或基底细胞癌），分叉肋、眶距增宽、颅骨异常、大脑镰钙化（D对）等症状时，称为“痣样基底细胞癌综合征”或“多发性基底细胞痣综合征”或“多发性基底细胞痣综合症”。